男，50岁。胸部不适2个月，无咳嗽、发热。胸部CT示右前上纵隔肿物，直径约3cm，边缘光滑，上极清晰。首先考虑的诊断是
A. 胸腺瘤
B. 胸骨后甲状腺
C. 支气管囊肿
D. 食管囊肿
E. 神经纤维癌

正确答案：A。胸腺瘤

解析：患者中老年男性，胸部不适（压迫症状），胸部CT示右前上纵隔肿物，直径约3cm，边缘光滑，上极清晰（良性肿物）。根据患者临床表现、实验室检查，诊断为胸腺瘤（P282），胸腺瘤（A对）多位于前上纵隔，成椭圆形阴影或分叶状，边缘界限清楚，多为良性，包膜完整。纵隔四分法，即以胸骨角与第四胸椎下缘的水平连线为界，把纵隔分为上下两部，下纵隔，再以心包前后界分为前中后三部分。胸骨后甲状腺肿，肿块常呈双侧性且不规则，随吞咽上下运动（B错）。支气管囊肿（C错）、食管囊肿（D错）均属良性，多呈圆形或椭圆形，壁薄，边缘界限清楚。囊内多为液体，但支气管囊肿和食管囊肿多位于中、后纵隔。神经纤维癌多位于后纵膈脊柱肋脊区内，以单侧多见，CT示边缘粗糙、边界不清晰，肿瘤较小时无明显症状，长大压迫神经干或恶变侵蚀时可发生疼痛（E错）。